气血两虚的舌象是
A. 舌质淡痩
B. 舌淡有齿痕
C. 舌尖有芒刺
D. 舌暗有瘀点
E. 舌红有裂纹

正确答案：A。舌质淡痩

解析：瘦薄舌总由气血阴液不足，不能充盈舌体，舌失濡养所致。淡白舌主气血两虚、阳虚（A对）。舌淡胖大而润，舌边有齿痕（B错）者，多属寒湿壅盛，或阳虚水湿内停；舌尖生点刺（C错），多为心火亢盛。舌暗有紫色斑点（D错）者，是瘀血阻滞于局部，或局部血络损伤所致，故常称之为瘀斑或瘀点。舌红绛而有裂纹（E错），多属热盛伤阴。因邪热内盛，阴液大伤，或阴虚液损，使舌体失于濡润，舌面萎缩所致。